呼吸衰竭的总体治疗措施不包括
A. 一般支持疗法
B. 使用吗啡
C. 必要时气管切开
D. 氧疗
E. 使用阿米三嗪

正确答案：B。使用吗啡

解析：呼吸衰竭的总体治疗原则是：加强呼吸支持，包括保持呼吸道通畅、纠正缺氧和改善通气等；呼吸衰竭病因和诱因的治疗；加强一般支持治疗以及对其他重要脏器功能的监测与支持。阿米三嗪为呼吸兴奋剂，吗啡具有抑制呼吸作用，不可用于呼吸衰竭治疗。掌握“呼吸衰竭”知识点。